以下哪项不是儿童生长发育常用的形态指标
A. 体重
B. 身高
C. 皮褶厚度
D. 胸围
E. 肺活量

正确答案：E。肺活量

解析：本题考查体格生长的常用指标。肺活量（E错，为本题正确答案）为呼吸系统的生理功能基本指标。衡量体格生长的指标通常有体重（A对）、身高（长）（B对）、头围、胸围（D对）、皮褶厚度（C对）等。